男性，60岁。吸烟史30年，咳嗽咳痰20年，活动后气急5年，偶有下肢水肿。体检：桶状胸，两肺呼吸音低，少量湿罗音，肺动脉瓣区第二心音亢进。最可能的诊断是为明确诊断，下列哪项不作首选
A. 胸部X线
B. 心电图
C. 肺功能
D. 血气分析
E. 超声心动图

正确答案：D。血气分析